男，9岁。未进早餐入校锻炼，半小时后四肢无力，平卧于地上，勉强翻身。血钾5.6mmol/L。注射葡萄糖酸钙后症状消失。一年中类似发作5次。可能的诊断是
A. 高钾血症
B. 低血糖
C. 癔病性瘫痪
D. 格林-巴利综合征
E. 周期性麻痹

正确答案：E。周期性麻痹

解析：患者9岁男孩，未进早餐入校锻炼（饥饿、运动），半小时后四肢无力，平卧于地上，勉强翻身（肌无力表现），血钾5.6mmol/L（血钾升高），注射葡萄糖酸钙后症状消失缓解（葡萄糖酸钙可缓解），一年中类似发作5次（呈发作性）。根据病史诊断为高钾型周期性瘫痪（E对）。高钾血症（A错）血钾会升高，但其临床表现为肢体麻木、肌肉酸痛、烦躁不安、神志不清等神经肌肉表现和心律失常等心血管症状，但不会有肌无力表现。低血糖（B错）表现为脸色苍白、心率增快、呼吸困难等交感神经兴奋症状，无血钾升高表现。癔病性瘫痪（C错）与饥饿、运动关系不大，发作多有精神诱因及有人在场，需要安慰及暗示等缓解。格林-巴利综合征（D错）有前期感染史及躯体感觉异常表现，病程呈进展性而不是发作性，血钾一般正常。